25岁，已婚妇女，婚后2年不孕，月经尚规律，停经45天后，阴道出血1个月，量少，无腹痛，妇检：宫颈充血，较软，子宫稍大，亦较软，附件（-），宫颈粘液涂片为羊齿状结晶，尿妊娠试验（-）应诊断为
A. 稽留流产
B. 葡萄胎
C. 功血
D. 宫外孕
E. 以上都不是

正确答案：C。功血

解析：尿妊娠试验（-）除外宫外孕、葡萄胎。稽留流产时子宫质地不软。功血，是一种常见的妇科疾病。是指异常的子宫出血，经诊查后未发现有全身及生殖器官器质性病变，而是由于神经内分泌系统功能失调所致。常表现为月经周期不规律、经量过多、经期延长或不规则出血。故选C。宫颈粘液涂片为羊齿状结晶说明为无排卵功血。掌握“功能失调性子宫出血”知识点。